下列哪项不是缺血－再灌注损伤的发生机制
A. ATP生成减少
B. 自由基生成增多
C. 体内代谢产物蓄积
D. 细胞内Ca2+升高
E. 白细胞大量活化

正确答案：A。ATP生成减少

解析：缺血－再灌注损伤的发生机制尚未彻底阐明，目前认为自由基生成增多（B对）、细胞内钙超载，即细胞内Ca2+升高（D对）和炎症反应过度激活，即白细胞大量活化（E对）是缺血－再灌注损伤的重要发病机制。ATP生成减少（A错，为本题正确答案）是自由基生成增多的机制。